下列关于新生儿脐风护理方法的叙述，错误的是
A. 病室保持安静
B. 病室光线宜暗
C. 尽量少动患儿
D. 每日洗涤脐部
E. 抽搐时不喂奶

正确答案：D。每日洗涤脐部

解析：脐风可由于护理不当，风冷水湿秽毒之邪所侵而致，每日洗涤脐部，或可加重，不符合小儿脐风的护理要求（D错，为本题正确答案）。对于小儿脐风的护理，要求尽量减少对患儿的刺激，故需保持病室安静，光线宜偏暗，尽量少触动患儿（ABC对）。抽搐时不宜给服药物及喂奶，避免呛咳或窒息（E对）。